医疗器械的基本质量特性是
A. 有效性和经济性
B. 有效性和适用性
C. 适用性和经济性
D. 安全性和有效性
E. 安全性和适用性

正确答案：D。安全性和有效性

解析：本题考查的是医疗器械的基本质量特性。医疗器械的基本质量特性是安全性和有效性（D对）。医疗器械是关系人民生命健康的特殊产品，它的基本质量特性就是安全性和有效性。